影响环境污染物在体内或靶部位蓄积量的因素是
A. 摄入量、生物半减期和作用时间
B. 吸收量、排出量和蓄积量
C. 进入途径、排出方式和作用时间
D. 吸收量、排出方式和作用时间
E. 进入途径、排出方式和作用时间

正确答案：A。摄入量、生物半减期和作用时间

解析：本题考查影响环境污染物在体内或靶部位蓄积量的因素。影响环境污染物在体内或靶部位蓄积量的因素是化合物的摄入量、生物半减期和作用时间（A对BCDE错）。